输卵管壶腹部妊娠其多见的结果为
A. 输卵管妊娠流产
B. 输卵管妊娠破裂
C. 胚胎可发育至3个月以上
D. 输卵管妊娠中最危险的一种
E. 胚胎死亡吸收

正确答案：A。输卵管妊娠流产

解析：输卵管妊娠流产多见于输卵管壶腹部妊娠，发病多在妊娠8～12周。掌握“异位妊娠”知识点。